由于卵巢功能衰竭引起卵巢性闭经，体内垂体卵泡刺激素水平应是
A. 增高
B. 降低
C. 波动很大
D. 持续下降
E. 测不出

正确答案：A。增高

解析：卵巢功能衰竭引起卵巢性闭经，体内垂体卵泡刺激素（FSH）水平应是增高（A对）。这是因卵巢功能衰竭后，雌孕激素水平下降，反馈性促进垂体分泌促性腺激素，致FSH升高，FSH＞40U/L。